下列哪项不符合疣状癌的病理特征
A. 以外生性、疣状缓慢生长和边缘推压为特征
B. 烟草可能是口腔疣状癌的主要病因学因素
C. 疣状癌以老年男性上腭多见
D. 病变开始时为边界清楚
E. 疣状癌呈推进式侵犯间质，无浸润边缘

正确答案：C。疣状癌以老年男性上腭多见

解析：本题考查疣状癌。下列疣状癌以老年男性上腭多见（C错，为本题正确答案）不符合疣状癌的病理特征。疣状癌为一种非转移性的高分化鳞癌的亚型，以外生性、疣状缓慢生长和边缘推压为特征（A对）。烟草可能是口腔疣状癌的主要病因学因素（B对）。疣状癌以老年男性下唇多见，颊、舌背、牙龈、牙槽黏膜均可发生。病变开始时为边界清楚（D对）、细的白色角化斑块，迅速变厚，发展成钝的乳头状或疣状，表面突起。疣状癌呈推进式侵犯间质，无浸润边缘（E对）。